ANUG的好发人群是
A. 婴幼儿
B. 青壮年
C. 中年
D. 老年
E. 女性患者

正确答案：B。青壮年

解析：好发人群常发生于青壮年，以男性吸烟者多见。在不发达国家或贫困地区亦可发生于极度营养不良或患麻疹、黑热病等急性传染病的儿童。掌握“坏死性溃疡性龈炎”知识点。